疟疾典型临床发作的机制是由于
A. 疟原虫在肝细胞内增殖
B. 疟原虫在红细胞内增殖
C. 大量裂殖子入血
D. 裂殖子及其代谢产物释放入血
E. 大量配子体入血

正确答案：D。裂殖子及其代谢产物释放入血

解析：疟疾典型临床发作是寒战、高热、继之大汗等症状，是在裂殖子及其代谢产物释放入血后（D对C错），刺激机体产生强烈的保护性免疫反应。疟原虫在红细胞内发育（B错）时一般无症状，红细胞破裂后，释放出裂殖子及其代谢产物，一部分被单核-吞噬细胞系统吞噬而消灭，一部分侵入新的红细胞，继续发育、繁殖，且发育时间不一，呈周期性发作。疟原虫在肝细胞内增殖（A错）会致复发。配子体入血继续发育，后在按蚊胃中发育或在人体内被清除。